男性，35岁，汽车撞伤左季肋区4小时，神志模糊，体温37.5℃，脉搏细弱，血压60/40mmHg，全腹压痛，无反跳痛，无尿。首选的治疗措施是
A. 静脉用强心药物
B. 立即手术治疗
C. 迅速补充平衡盐溶液
D. 利尿剂改善肾功能
E. 应用抗生素

正确答案：C。迅速补充平衡盐溶液

解析：患者左季肋区外伤史、全腹压痛、无反跳痛提示可能出现脾破裂、腹腔内出血，神志模糊、脉搏细弱、血压60/40mmHg，无尿提示出现重度休克（中度休克收缩压为90～70mmHg，重度休克收缩压在70mmHg以下或测不到），综合考虑其诊断应为重度低血容量性休克。此时，首选的治疗措施应为迅速补充平衡盐溶液（C对）并积极准备急诊手术开腹止血，但手术治疗必须在休克纠正的基础上或纠正时进行，不作为首选（B错）。静脉用强心药物（A错）、利尿剂改善肾功能（D错）、应用抗生素（E错）均为休克纠正后的一般治疗措施。